左心室流入道和流出道的分界是
A. 二尖瓣前瓣
B. 二尖瓣后瓣
C. 前乳头肌
D. 后乳头肌
E. 二尖瓣后瓣,腱索和乳头肌

正确答案：A。二尖瓣前瓣

解析：二尖瓣前瓣（A对）为左心室流入道和流出道的分界，将左心室腔分为左后方的流入道和右前方的流出道。